大肠菌群最近似值表示大肠菌群的可能数相当于食品的数量是
A. 1g或1ml
B. 10g或10ml
C. 100g或100ml
D. 1kg或1L
E. 100mg或0.1ml

正确答案：A。1g或1ml

解析：本题考查大肠菌群最近似值。大肠菌群最近似值表示大肠菌群的可能数相当于食品的数量是1g或1ml（A对BCDE错）。